健康教育与健康促进计划设计中“社会诊断”的任务是
A. 评估目标人群中的社会环境及其生活质量
B. 确定主要的健康问题及其影响因素
C. 确定引起健康问题的相关行为因素
D. 确定社区常见疾病的危险因素
E. 评估目标人群的健康知识、态度与行为

正确答案：A。评估目标人群中的社会环境及其生活质量